一项以医院为基础的罕见病的病例对照研究，其符合规定的病例数很少且病例的某种构成特殊，不易找到均衡的对照组，但又必须保证研究效率。选择对照的形式为
A. 频数匹配
B. 个体匹配
C. 完全匹配
D. 不匹配
E. 成组匹配

正确答案：B。个体匹配